某男，55岁。恶寒发热，无汗，头身痛，伴有形寒肢冷，面白声微；舌淡苔白，脉浮无力。宜采用的治法是
A. 助阳解表
B. 益气解表
C. 养血解表
D. 滋阴解表
E. 散寒解表

正确答案：A。助阳解表

解析：本题考查的是扶正解表法。恶寒发热，无汗，头身痛，伴有形寒肢冷，面白声微；舌淡苔白，脉浮无力。宜采用的治法是助阳解表（A对）。扶正解表法：适用于体虚外感表证。体虚随气虚、血虚、阴虚、阳虚的不同，又分为益气解表法、养血解表法、滋阴解表法、助阳解表法四种。（1）益气解表（B错）法：适用于气虚外感表证，症见恶寒发热，无汗，头痛鼻塞，倦怠无力，气短懒言，舌淡苔白，脉浮无力。（2）养血解表（C错）法：适用于血虚外感表证，症见头痛身热，微寒无汗，面色不华，唇甲色淡，心悸头晕，舌淡苔白，脉细等。（3）滋阴解表（D错）法：适用于阴虚外感表证，症见恶寒发热，头痛，干咳少痰，手足心热，心烦，口渴，咽干，舌红，脉细数。（4）助阳解表法：适用于阳虚外感表证，症见恶寒发热，无汗，头身痛等表证外，兼见形寒肢冷，面白声微，舌淡苔白，脉浮无力。散寒解表（E错）为风寒感冒的治法。风寒感冒：【症状】恶寒重，发热轻，无汗头痛，肢体酸痛，或鼻塞声重，或鼻痒喷嚏，流涕清稀，咽痒，咳嗽，咳痰稀白。舌苔薄白，脉浮紧。【治法】辛温解表，宣肺散寒。【方剂应用】基础方剂为荆防败毒散（荆芥、防风、前胡、柴胡、羌活、独活、川芎、茯苓、枳壳、桔梗、甘草）加减。【中成药应用】常用中成药有荆防颗粒、感冒清热颗粒、感冒软胶囊、九味羌活丸、葛根汤颗粒。